某省两名糖尿病患者服用标识为“甲制药厂”的“糖脂宁胶囊”（批号为02733）后死亡，经药品监督部门核查，甲制药厂未生产过批号为02733的“糖脂宁胶囊”，致人死亡的药品系乙非法生产，经药品检验所检验，该药品中非法添加了化学物质“格列本脲”，对本事件的处理，正确的有
A. 批号为02733的“糖脂宁胶囊”为假药
B. 对乙按照生产、销售假药行为追究其刑事责任
C. 对甲和乙同时按照生产、销售劣药行为追究其法律责任
D. 甲制药厂应对其生产的所有“糖脂宁胶囊”实施召回
E. 甲制药厂应对涉案的“糖脂宁胶囊”（批号为02733）实施召回

正确答案：A、B。批号为02733的“糖脂宁胶囊”为假药；对乙按照生产、销售假药行为追究其刑事责任

解析：本题考查生产、销售、使用假药的法律责任。某省两名糖尿病患者服用标识为“甲制药厂”的“糖脂宁胶囊”（批号为02733）后死亡，经药品监督部门核查，甲制药厂未生产过批号为02733的“糖脂宁胶囊”，致人死亡的药品系乙非法生产，经药品检验所检验，该药品中非法添加了化学物质“格列本脲”，对本事件的处理，正确的有批号为02733的“糖脂宁胶囊”为假药（A对）；对乙按照生产、销售假药行为追究其刑事责任（B对）。假药的界定：《药品管理法》第九十八条第一款、第二款规定，禁止生产（包括配制，下同）、销售、使用假药。有下列情形之一的，为假药：①药品所含成分与国家药品标准规定的成分不符；②以非药品冒充药品或者以他种药品冒充此种药品；③变质的药品；④药品所标明的适应症或者功能主治超出规定范围。生产、销售、使用假药的法刑事责任认定及刑罚：根据《刑法》第一百四十一条规定，生产、销售假药的，处三年以下有期徒刑或者拘役，并处罚金；对人体健康造成严重危害或者有其他严重情节的，处三年以上十年以下有期徒刑，并处罚金；致人死亡或者有其他特别严重情节的，处十年以上有期徒刑、无期徒刑或者死刑，并处罚金或者没收财产。